女性，48岁。发作性剑突下及右上腹绞痛3天，伴有寒战，半年前有过类似发作史。查体：体温39℃，脉搏110次/分，血压140/85mmHg。血常规检查：WBC12×10⁹/L，N80%，神志清楚，皮肤巩膜轻度黄染，右肋缘下扪及肿大的胆囊，轻度触痛。该病人可能的诊断是
A. 细菌性肝脓肿
B. 肝外胆管结石并胆管炎
C. 急性化脓性胆囊炎
D. 肝内胆管结石并胆管炎
E. 急性梗阻性化脓性胆管炎

正确答案：B。肝外胆管结石并胆管炎

解析：患者中年女性，右上腹绞痛、体温39℃（中等度热，正常值36～37℃）、皮肤、巩膜轻度黄染（黄疸）（Charcot三联征，胆管炎典型表现），胆囊肿大多为肝外胆管结石阻塞胆总管下段，引起胆汁分泌受阻，胆总管压力增高，胆汁经胆囊颈管逆流充盈胆囊。患者最可能的诊断是肝外胆管结石并胆管炎（B对）。细菌性肝脓肿（P414）（A错）主要症状是寒战、高热、肝区疼痛和肝肿大，一般无既往发作病史和胆囊肿大。急性化脓性胆囊炎（C错）一般无寒战，无黄疸。肝内胆管结石并胆管炎（P442）（D错）主要症状是急性胆管炎引起的寒战、高热和腹痛，局限于肝叶的结石多无黄疸及胆囊肿大。急性梗阻性化脓性胆管炎（P445）（E错）典型临床表现为Reynolds五联征：腹痛、寒战高热、黄疸、休克、中枢神经系统受累，患者神志清楚、血压正常，无休克、中枢神经系统受累之表现。